中度休克者主要输入
A. 晶体液
B. 全血
C. 胶体液
D. 晶体液和胶体液
E. 以上都不对

正确答案：B。全血

解析：中度休克者，则以输全血为主，适当补充其他液体，第1小时可输血1000ml左右。掌握“口腔颌面部创伤急救”知识点。